关于公民的健康权利描述错误的是
A. 是一种无限的权利
B. 是人们为了获得公平、平等的机会而存在的基本权利
C. 社会有责任和义务提供一定的保健服务
D. 责任和义务以不使权利人的境况更糟为限
E. 分为“自然权利”和“社会权利”

正确答案：A。是一种无限的权利

解析：公民的健康权利是一种有限的权利，是人们为了获得公平、平等的机会而存在的基本权利。当人们因为健康原因导致不能在社会中得到公平的机会平等时，社会有责任和义务提供一定的保健服务，这种责任和义务以不使权利人的境况更糟为限。健康作为一项公民享有的权力和利益，有自然意义上的和社会意义上的不同。有“自然权利”和“社会权利”。掌握“健康伦理”知识点。